对于原发性三叉神经痛有效的药物是
A. 卡马西平
B. 苯妥英钠
C. 氯硝西泮
D. 山莨菪碱
E. 以上均是

正确答案：E。以上均是

解析：对原发性三叉神经痛可采取的药物治疗有：①卡马西平；②苯妥英钠；③氯硝西泮；④山莨菪碱；⑤七叶莲。掌握“三叉神经痛”知识点。